来自下肢深部静脉的血栓栓子最常引起栓塞的器官是
A. 脑
B. 肺
C. 肝
D. 心
E. 肾

正确答案：B。肺

解析：来自下肢深部静脉（如腘静脉、股静脉和髂静脉）的血栓栓子，随静脉回流入心后可到达肺，常引起肺（B对）栓塞。脑（A错）、肝（C错）、肾（E错）栓塞的栓子多来自左心腔。心（D错）极少发生栓塞。